十二指肠溃疡穿孔12小时以内，既往有出血史，周围炎症水肿较轻，一般情况好，首选的手术方式是
A. 胃大部切除术
B. 全胃切除术
C. 胃肠吻合术
D. 胃大部切除术加淋巴结清扫术
E. 高选择性迷走神经切断术

正确答案：A。胃大部切除术

解析：十二指肠溃疡穿孔急诊根治性手术包括胃大部切除术（A对BD错）、十二指肠穿孔行迷走神经切断加胃窦切除术、缝合穿孔后行迷走神经切断或胃空肠吻合术（C错）、高选择性迷走神经切断术等（E错）。